长春新碱
A. 作用于肿瘤细胞增殖中的G₁期
B. 作用于S期
C. 作用于M期
D. 属周期非特异性药
E. 对儿童急性淋巴细胞白血病疗效较好

正确答案：C、E。作用于M期；对儿童急性淋巴细胞白血病疗效较好

解析：本题考查长春新碱。长春新碱为长春碱类抑制蛋白质合成与功能的药物，主要作用于有丝分裂M期（C对AB错），干扰微管蛋白合成，用于急性白血病、急性和慢性淋巴细胞白血病，对儿童急性淋巴细胞白血病疗效较好（E对）。阿霉素是一种抗肿瘤抗生素，可抑制RNA和DNA的合成，对RNA的抑制作用强，抗菌谱较广，属周期非特异性药物（D错）。